下列骨中属于典型长骨的是
A. 髂骨
B. 肋骨
C. 指骨
D. 距骨
E. 胸骨

正确答案：C。指骨

解析：长骨分布于四肢，指骨属长骨（C对）。胸骨为长方形扁骨（E错）。肋骨属扁骨，分为体和前 、后两端（B错）。髋骨为不规则骨（A错）。跗骨共 7 块，属短骨， 分前、中、后 三列 ，后列包括上方的距骨和下方的跟骨（D错）。